患者因深龋一次垫底银汞充填后1周出现自发痛，冷热痛持续，不能咬物，其原因最可能为
A. 备洞时刺激牙髓
B. 充填时未垫底
C. 流电作用
D. 诊断错误
E. 充填材料刺激

正确答案：D。诊断错误

解析：本题考查充填后疼痛。患者有自发痛，冷热痛持续，说明牙髓已有炎症反应，可能原因为对牙髓状况判断失误（D对）。备洞时刺激牙髓，可激惹牙髓致牙髓充血，出现激发痛，但无自发痛（A错）。充填时未垫底，温度刺激可通过充填材料刺激牙髓，引起冷热刺激痛，但不会出现自发痛（B错）。电流作用引起的疼痛，表现为与对颌牙接触时疼痛，无冷热刺激痛（C错）。充填材料刺激可造成牙髓充血，出现短暂的激发痛，无持续（E错）。